育龄女性在无防护的性生活或避孕失败72小时内，宜使用的口服紧急避孕药物是
A. 炔雌醇去氧孕烯(30㎍/150㎍）
B. 十一酸睾酮(40mg）
C. 复方醋酸环丙孕酮(35㎍/2mg）
D. 左炔诺孕酮(1.5mg）
E. 炔雌醇屈螺酮(30㎍/3mg）

正确答案：D。左炔诺孕酮(1.5mg）

解析：本题考查避孕药。育龄女性在无防护的性生活或避孕失败72小时内，宜使用的口服紧急避孕药物是左炔诺孕酮(1.5mg）（D对）。左炔诺孕酮为紧急避孕药，副作用大，每月使用不超过1次，不宜作为常规避孕方式。炔雌醇去氧孕烯（A错）及炔雌醇屈螺酮（E错）均为短效口服避孕药,既有避孕的作用,也有调整月经周期的作用。十一酸睾酮（B错）为激素药，用于治疗原发性或继发性睾丸功能减退，男孩体质性青春期延迟，乳腺癌转移的姑息性治疗。复方醋酸环丙孕酮（C错）为生殖系统的性激素和调节剂，用于男性降低性欲倒错的冲动。